不会诱发肝性脑病的是
A. 上消化道出血
B. 感染
C. 口服氨基糖苷类抗生素
D. 高蛋白饮食
E. 使用地西泮类药物

正确答案：C。口服氨基糖苷类抗生素

解析：肝性脑病的常见诱因有消化道出血（A错）、大量排钾利尿、放腹腔积液、高蛋白饮食（D错）、催眠镇静药（E错）、麻醉药、便秘、尿毒症、外科手术及感染（B错）等。故口服抗生素（C对）不是肝性脑病的诱因。